5C）并伴有头痛、全身酸痛到药店购药，药师应推荐的药品是
A. 酚麻美敏片
B. 萘甲唑啉滴鼻液
C. 氯苯那敏片
D. 对乙酰氨基酚片
E. 奥司他韦胶囊

正确答案：D。对乙酰氨基酚片

解析：本题考查感冒用药。对乙酰氨基酚（D对）用于感冒后有微热或流感后出现高热，并伴有明显头痛、关节痛、肌肉痛或全身酸痛，治疗此症状的还有阿司匹林、布洛芬。感冒致鼻塞选用含伪麻黄碱的制剂，可以收缩鼻黏膜。局部选用1%麻黄素、萘甲唑啉滴鼻液（B错）、羟甲唑啉滴鼻剂、赛洛唑啉滴鼻剂等。感冒初始阶段所致打喷嚏、流鼻涕选用含抗过敏成分制剂，如盐酸伪麻黄碱，氯苯那敏片（C错）。感冒所致的咳嗽选用含右美沙芬的制剂，如酚麻美敏片（A错）。奥司他韦胶囊（E错）用于成人及1岁和1岁以上儿童的甲型和乙型流感的治疗。